《药品经营许可证》的有效期是
A. 3个月
B. 1年
C. 5年
D. 3年

正确答案：C。5年

解析：本题考查的是有效期的相关内容。《药品经营许可证》的有效期是5年（C对）。药品经营许可证分为正本和副本，有效期为5年。药品经营许可证样式由国家药品监督管理局统一制定。药品经营许可证电子证书与纸质证书具有同等法律效力。禁止伪造、变造、出租、出借、买卖药品经营许可证。有效期为3个月（A错）的是《药品类易制毒化学品购用证明》。《药品类易制毒化学品购用证明》由国家药品监督管理部门统一印制，有效期为3个月。有效期为1年（B错）的是《麻醉药品、第一类精神药品运输证明》。《麻醉药品、第一类精神药品运输证明》有效期为1年（不跨年度）。有效期为3年（D错）的是《麻醉药品、第一类精神药品购用印鉴卡》。《麻醉药品、第一类精神药品购用印鉴卡》有效期为3年。